男，51岁。胸骨后剧烈疼痛伴大汗淋漓4小时。血压80/40mmHg，心率134次/分，面色苍白，四肢发冷。心电图提示广泛心肌梗死。该患者低血压的原因是
A. 血容量不足
B. 合并右室梗死
C. 舒张期充盈不足
D. 心源性休克
E. 疼痛性休克

正确答案：D。心源性休克

解析：患者起病急，病程短，伴休克，心电图提示广泛心肌梗死。急性大面积心肌梗死者后休克，主要是因心脏泵衰竭，心排血量急剧下降所致，即心源性休克（D对）。血容量不足（A错）常因大出血或体液丢失，或液体积存于第三间隙，导致有效循环量降低引起，该患者没有引起血容量不足的的病因以及支持该诊断的体查或检查结果，故排除A。合并右室梗死（B错）在MI患者中少见，其主要病理生理改变是急性右心衰竭的血流动力学变化，右心房压力增高，高于左心室舒张末期压，心排血量减低，血压下降，但未必是休克。舒张期充盈不足（C错），是由于心室充盈受限所致，主要见于缩窄性心包炎和限制性心肌病，广泛性心肌梗死主要是心脏收缩功能受限，不会影响舒张功能（C错）。疼痛性休克（E错）多发生于外伤患者，发生极为迅速，且具有很快逆转倾向，与本病患者不符。